“冬眠合剂”通常指
A. 苯巴比妥+异丙嗪+吗啡
B. 苯巴比妥+氯丙嗪+吗啡
C. 氯丙嗪+异丙嗪+吗啡
D. 氯丙嗪+异丙嗪+哌替啶
E. 氯丙嗪+阿托品+哌替啶

正确答案：D。氯丙嗪+异丙嗪+哌替啶